突触前抑制的特点是
A. 突触前膜超极化
B. 潜伏期长，持续时间长
C. 突触前轴突末梢释放抑制性递质
D. 突触后膜的兴奋性降低
E. 通过轴突-树突突触结构的活动来实现

正确答案：B。潜伏期长，持续时间长